女，24岁。停经6周诊断为早孕，行人工流产术，吸宫后探宫腔发现探不到宮底，出血不多，自述心悸、轻度腹痛及恶心。此时该患者首选的处理方法是
A. 吸氧，给予升压药
B. 继续手术，清空子宫
C. 暂停手术，密切观察病情
D. 静脉注射阿托品
E. 立即行剖腹探查术

正确答案：C。暂停手术，密切观察病情

解析：该患者停经6周诊断为早孕，行人工流产术，吸宫后探宫腔发现探不到宮底（手术时突然感到无宫底感觉，或手术器械进入深度超过原来所测得深度，提示子宫穿孔），出血不多，自述心悸轻度腹痛及恶心，最可能的诊断是子宫穿孔。应立即停止手术，密切观察病情（C对）。穿孔小，无脏器损伤或内出血，手术已完成，可注射子宫收缩剂保守治疗，并给予抗生素预防感染。同时密切观察血压、脉搏等生命体征。若宫内组织未吸净，应由有经验医师避开穿孔部位，也可在B型超声引导下或腹腔镜下完成手术（B错）。破口大、有内出血或怀疑脏器损伤，应剖腹探查（E错）或腹腔镜检查，根据情况做相应处理。患者无血压降低征象，不用给予升压药（A错）。静脉注射阿托品（P384）（D错）为严重的人工流产综合反应的处理方法。